某男，40岁。体瘦，因肝火犯胃导致脘胁疼痛、口苦嘈杂、呕吐酸水、不喜热饮。治当泻火、疏肝、和胃、止痛，宜选用的成药是
A. 越鞠丸
B. 胃苏颗粒
C. 健脾消食丸
D. 左金丸
E. 木香顺气颗粒

正确答案：D。左金丸

解析：本题考查的是左金丸的功能。某男，40岁。体瘦，因肝火犯胃导致脘胁疼痛、口苦嘈杂、呕吐酸水、不喜热饮。治当泻火、疏肝、和胃、止痛，宜选用的成药是左金丸（D对）。左金丸：【功能】泻火，疏肝，和胃，止痛。越鞠丸（A错）：【功能】理气解郁，宽中除满。胃苏颗粒（B错）：【功能】理气消胀，和胃止痛。健脾消食丸（C错）：【功能】健脾，和胃，消食，化滞。木香顺气丸（E错）：【功能】行气化湿，健脾和胃。